分布于头侧的经脉是
A. 厥阴经
B. 太阴经
C. 太阳经
D. 阳明经
E. 少阳经

正确答案：E。少阳经

解析：头面部主要分布的是手足阳经，其分布特点是手、足阳明经行于面部、额部；手、足少阳经行于头侧部（E对）；手、足太阳经行于面颊、头顶及头后部。